下列有关胸主动脉的描述，正确的是
A. 在第6胸椎下缘续主动脉弓
B. 位于后纵隔内，全长位于脊柱左侧
C. 在10胸椎高度穿膈肌的主动脉裂孔
D. 下段在食管前方
E. 胸导管和奇静脉位于其下段后方

正确答案：C。在10胸椎高度穿膈肌的主动脉裂孔

解析：胸主动脉在第4胸椎（A错）的左侧续于主动脉弓。位于后纵隔内，初沿脊柱的左侧下行，逐渐转向其前方（B错）。在10胸椎高度穿膈肌的主动脉裂孔（C对）。